患者眼睑浮肿，继则四肢全身皆肿，来势迅速，伴恶寒发热，肢体酸楚，小便不利等症。舌苔薄白，脉浮滑。可诊断为
A. 湿毒浸淫
B. 水湿浸渍
C. 湿热壅盛
D. 瘀水互结
E. 风水相搏

正确答案：E。风水相搏

解析：风邪袭表，肺失宣降，不能通调水道，下输膀胱故见眼睑浮肿，由颜面先发继则四肢全身皆肿，来势迅速，肢体酸楚，小便不利；风邪兼寒，邪在肌表，卫阳被遏，则伴恶寒发热等症；舌苔薄白，脉浮滑均为风水相搏证的表现（E对）。湿毒浸淫证（A错）的特点为眼睑浮肿，延及全身，身发痈疡，恶风发热，小便不利，舌质红，苔薄黄。水湿浸渍证（B错）的特点为全身水肿，按之没指，伴有胸闷腹胀，身重困倦，纳呆，泛恶，小便短少。湿热壅盛证（C错）的特点为浮肿明显，肌肤绷急，腹大胀满，胸闷烦热，口苦口干，大便干结，小便短赤。瘀水互结证（D错）的特点为眩晕头昏胀痛，小便不利，肢体水肿，面色黧黑或晦暗。